男，27岁。发热头晕视物模糊1周。血常规示Hb69g/L，WBC15×10⁹/L，分类中可见原始细胞。对诊断最有价值的检查是
A. 血涂片碱性磷酸酶染色
B. 骨髓细胞形态学检查
C. 骨髓细胞染色体检查
D. 脑脊液幼稚细胞检查
E. 骨髓细胞化学染色检查

正确答案：B。骨髓细胞形态学检查

解析：患者青年男性，发热、头晕、视物模糊1周（感染、贫血表现），血常规示Hb69g/L（成年男性Hb正常值120～160g／L），提示贫血，WBC15×10⁹／L（正常4～10×10⁹／L）增多，分类中可见原始细胞（正常人外周血中不会出现原始细胞），提示急性白血病，为确定诊断最有价值的检查是骨髓穿刺细胞形态学检查（B对），原始细胞≥骨髓有核细胞（ANC）的30%（FAB分型）或≥20%（WHO分型）即可诊断为急性白血病。血涂片碱性磷酸酶染色（A错）可反映中性粒细胞的成熟程度和功能，对急性、慢性粒细胞白血病、再生障碍性贫血、类白血病反应的鉴别诊断有一定价值；骨髓细胞染色体检查（C错）对明确急性白血病的遗传学异常及指导治疗有帮助，但不是确诊急性白血病的依据；脑脊液幼稚细胞检查（P573）（D错）主要用于中枢神经系统白血病的诊断；骨髓细胞化学染色检查（P572）（E错）主要用于协助鉴别各类白血病。